男，28岁。受凉后发热、咳嗽、咳痰一周，气促2天，意识模糊一小时。查体：T39.8℃，血压80/50mmHg，口唇发绀，双肺可闻及较多湿啰音，心率109次/分，未闻及杂音，四肢冷。血常规WBC21×10⁹/L，N0.90。该患者最可能诊断是
A. 中枢神经系统感染
B. 急性左心衰
C. 重症肺炎
D. 干酪性肺炎
E. 肺栓塞

正确答案：C。重症肺炎

解析：患者为青年男性，受凉后出现发热、咳嗽、咳痰及气促症状，体温38℃（非感染性疾病一般小于38℃），血压下降，口唇发绀并且双肺出现湿啰音，WBC21×10⁹/L（正常值4～10×10⁹/L），N0.90（正常为0.50～0.75），提示存在感染，以上症状及特征都符合社区获得性肺炎的诊断依据，其中呼吸困难和口唇发绀表明肺炎已达重度，收缩压<90mmHg或舒张压≤60mmHg，有休克表现，因此本例首选诊断应为重症肺炎（C对）。中枢神经系统感染（A错）会出现发热和白细胞增多等感染性表现，但是一般会伴有头痛、精神症状和脑膜刺激征等神经系统症状，本患者未出现这类典型神经系统症状，所以不作为首选诊断。急性左心衰（P174-P175）（B错）常出现严重呼吸困难、咳粉红色泡沫痰等症状，听诊时两肺满布湿啰音和哮鸣音，但是通常会出现舒张期奔马律，本患者心脏未闻及杂音，因此不作为首选诊断。干酪性肺炎（P68）（D错）是继发型肺结核的一种类型，常出现高热、盗汗、虚脱、咳脓痰等症状，但其中性粒细胞比例一般不高，而本患者中性粒细胞（N）比例达到0.90（正常值0.50～0.70），因此不作为首选诊断。肺栓塞（P100）（E错）典型症状为胸痛、呼吸困难、咯血，听诊可闻及第二心音亢进以及三尖瓣收缩期杂音，但一般不会有发热和血象增高，本患者无咯血，心脏听诊也未闻及杂音，同时伴有发热和血象增高，与肺栓塞的典型症状及体征不符，故不作为首选诊断。